影响健康的主要因素是
A. 社会经济环境
B. 物质环境
C. 个体因素
D. 卫生服务的可及性
E. 以上都是

正确答案：E。以上都是

解析：影响健康的因素归纳为4大类：社会经济环境、物质环境、个体因素，以及卫生服务的可及性。掌握“预防医学概论、健康及三级预防策略”知识点。